《传染病防治法》规定，国家对传染病实行防治方针和原则
A. 预防为主，防治结合，统一管理，依靠科学，依靠群众
B. 预防为主，防治结合，分类管理，依靠科学，依靠群众
C. 预防为主，防治结合，划区管理，依靠科学，依靠群众
D. 预防为主，防治结合，分片管理，依靠科学，依靠群众
E. 预防为主，防治结合，层级管理，依靠科学，依靠群众

正确答案：B。预防为主，防治结合，分类管理，依靠科学，依靠群众

解析：国家对传染病防治实行预防为主的方针，防治结合、分类管理、依靠科学、依靠群众。掌握“传染病的预防”知识点。